釉质中无机物占总重量的
A. 94%～95%
B. 95%～96%
C. 96%～97%
D. 97%～98%
E. 0.99

正确答案：C。96%～97%

解析：釉质（牙釉质）是人体中最硬的组织，由占总重量96%～97%的无机物以及少量有机物和水所组成。按体积计，其无机物占总体积的86%，有机物占2%，水占12%。掌握“牙釉质”知识点。